用酸度计测量溶液的pH值时，使用的指示电极是
A. 氢电极
B. 铂电极
C. 银电极
D. 玻璃电极
E. 饱和甘汞电极

正确答案：D。玻璃电极

解析：本题考查测定溶液pH常用的电极。酸度计测定溶液的pH值时，以玻璃电极（D对）作指示电极，饱和甘汞电极（E错）作参比电极。